支气管哮喘的肺功能异常，主要表现在
A. 肺活量减少
B. 最大通气量增加
C. 第一秒用力呼气容积减少
D. 弥散量减少
E. 肺容量减少

正确答案：C。第一秒用力呼气容积减少

解析：第一秒用力呼气容积是最好的测定肺功能的指标。掌握“支气管哮喘”知识点。